胶囊剂包括
A. 硬胶囊
B. 软胶囊
C. 缓释胶囊
D. 控释胶囊
E. 肠溶胶囊

正确答案：A、B、C、D、E。硬胶囊；软胶囊；缓释胶囊；控释胶囊；肠溶胶囊

解析：本题考查胶囊剂的分类。胶囊剂包括硬胶囊（A对）、软胶囊（B对）、缓释胶囊（C对）、控释胶囊（D对）和肠溶胶囊（E对）。